怀疑小儿患时行疾病时，特别要注意询问
A. 家族史
B. 生产史
C. 喂养史
D. 生长发育史
E. 预防接种史

正确答案：E。预防接种史

解析：小儿时行疾病属流行性疾病，具有传染性，通过预防接种史可以详细了解小儿是否有患时行疾病的可能性（E对）。询问家族史的目的主要是确认小儿是否患有遗传性疾病（A错）。生产史涉及母亲怀孕时及生产时的情况（B错），喂养史及生长发育史主要是为了解小儿详细成长情况，与时行疾病关系不大（CD错）。